大气卫生标准比生产车间卫生标准制订更严格的原因是
A. 大气污染影响的范围广，包括老、弱、幼、病、孕等敏感人群
B. 大气中的有害物质受生产周期和气象条件的影响而经常变动
C. 各种有害物质对机体的有害作用类型不同
D. 有些大气污染物能对人或动植物产生急性危害
E. 大气污染物对人体的危害有联合作用

正确答案：A。大气污染影响的范围广，包括老、弱、幼、病、孕等敏感人群

解析：本题考查大气卫生标准制订更严格的原因。大气污染对人类健康影响的范围广，包括老、弱、幼、病、孕等敏感人群（A对BCDE错），所以相比生产车间卫生标准，大气卫生标准制订要更加严格。